兼有复合树脂的美观和玻璃离子释放氟离子双重优点的是
A. 氧化锌丁香油粘固剂
B. 氢氧化钙
C. 复合体
D. 银汞合金
E. 磷酸锌粘固剂

正确答案：C。复合体

解析：复合体是复合树脂和玻璃离子体的组合，既具有复合树脂的美观性能，又具有玻璃离子体释放氟离子的优点。掌握“牙体充填材料之玻璃离子及复合体”知识点。